下列不是艾滋病危害严重性表现的是
A. 感染的普遍性
B. 威胁的长期性
C. 控制的困难性
D. 资源的消耗性
E. 治疗的困难性

正确答案：A。感染的普遍性